治疗甲氧西林敏感金葡菌引起的肺炎宜选用
A. 两性霉素
B. 苯唑西林
C. 利巴韦林
D. 阿奇霉素
E. 阿莫西林/克拉维酸钾

正确答案：B。苯唑西林